男，63岁，咳嗽、痰中带血丝半年余，吸烟40余年。胸部X线片示右上肺近肺门处肿块影。如拟手术治疗，下列不属于手术禁忌症的是
A. 对侧肺门淋巴结转移
B. 肝转移
C. 锁骨上淋巴结转移
D. 同侧肺门淋巴结转移
E. 脑转移

正确答案：D。同侧肺门淋巴结转移

解析：老年男性患者，有长期吸烟史，咳嗽、痰中带血，胸部X线片示右上肺近肺门处肿块，结合患者病史、临床表现和影像学检查，该患者最可能的诊断为右侧中央型肺癌。肺癌手术禁忌症有：①远处转移，如脑（E对）、骨、肝（B对）等器官转移（即M1病例）；②心、肺、肝、肾功能不全，全身情况差的病人；③肺门淋巴结转移已达对侧（A对）、纵隔淋巴结转移，无法清除者；④严重侵犯周围器官及组织，估计切除困难者；⑤胸外淋巴结转移，如锁骨上（N3）（C对）等。同侧肺门淋巴结转移（D错，为本题正确答案）属于N1，尚有手术切除的可能，不属于手术禁忌证。